阻断α受体
A. 麻黄碱
B. 异丙肾上腺素
C. 两者均能
D. 两者均不能

正确答案：D。两者均不能

解析：本题考查麻黄碱和异丙肾上腺素。麻黄碱和异丙肾上腺素都不能阻断α受体（D对）。麻黄碱为α、β受体激动剂。异丙肾上腺素为β受体激动剂。